手阳明大肠经的手三里位于
A. 曲池穴下1寸
B. 曲池穴下2寸
C. 曲池穴下3寸
D. 阳溪穴上8寸
E. 阳溪穴上9寸

正确答案：B。曲池穴下2寸

解析：手三里位于前臂，肘横纹下2寸，阳溪与曲池连线上；曲池位于肘区，在尺泽与肱骨外上髁连线中点的凹陷中；阳溪在腕区，腕背侧远端横纹桡侧，桡骨茎突远端，解剖学“鼻烟窝”中；肘横纹至腕掌（背）侧远端横纹的距离为12寸；故手三里位于曲池下2寸（B对AC错）、阳溪上10寸（DE错）。